不属于血栓结局描述的是
A. 溶解
B. 钙化
C. 软化
D. 机化
E. 硬化

正确答案：E。硬化

解析：在心脏和血管内血液发生凝固或者血液中某些有形成分凝集形成的固体质块称为血栓。血栓的结局包括软化（C对）、溶解（A对）和吸收、机化（D对）和再通、钙化（B对）。硬化（E错，为本题正确答案）是血管的病理变化，动脉硬化指动脉壁增厚、失去弹性、硬化性的一类疾病，包括①AS（动脉粥样硬化），如发生在冠状动脉；②细动脉硬化，常见于高血压病和糖尿病；③动脉中层钙化，少见。